某因素与某病有统计学上的关联，特别是RR或OR较大时，要确定该因素为某病的病因尚需
A. 肯定该因素须发生在疾病之前
B. 排除选择偏性
C. 排除信息偏性
D. 排除混杂
E. 排除该因素与疾病的联系为虚假联系和间接关联

正确答案：E。排除该因素与疾病的联系为虚假联系和间接关联

解析：本题考查虚假关联和间接关联。某因素与某病有统计学上的关联，特别是RR或OR较大时，要确定该因素为某病的病因尚需排除该因素与疾病的联系为虚假联系和间接关联（E对ABCD错）。RR和OR较大只能说明两者有关联，但是并不能说明是否存在统计学关联，要想证明其有统计学关联要排除虚假关联和间接关联。